孕妇尿中与胎儿胎盘单位功能关系密切的激素是
A. 雌酮
B. 雌二醇
C. 雌三醇
D. 孕酮
E. 睾酮

正确答案：C。雌三醇

解析：雌激素（E）分为雌酮（E1）、雌二醇（E2）及雌三醇（E3）。妊娠期间，胎盘产生大量E3，测血或尿中E3（C对）水平可反映胎儿胎盘功能状态。雌酮（A错）主要是绝经后妇女产生的雌激素。雌二醇（B错）在雌激素中活性最强，是卵巢分泌的主要性激素之一，对维持女性生殖功能及第二性征有重要作用。妊娠时孕酮血清（P424）（D错）水平随孕期增加而稳定上升，孕激素的作用主要是使子宫内膜转化为分泌期，利于胚胎着床；并防止子宫收缩，使子宫在分娩前处于静止状态。睾酮（E错）主要由卵巢和肾上腺分泌的雄烯二酮转化而来，不能反映胎盘功能。